昂丹司琼主要用于
A. 晕动症引起的呕吐
B. 除晕动病外的各种呕吐
C. 胃食管反流病
D. 肿瘤化疗引起的呕吐
E. 内耳眩晕症引起的呕吐

正确答案：D。肿瘤化疗引起的呕吐

解析：昂丹司琼应用于癌症放疗、化疗引起的恶心、呕吐（D对）。